某企业职工因为冠心病在某三甲医院住院6天，产生医药费用9000元。出院结算时，医院先扣除自费项目1200元，在剩下的7800元中，扣除起付标准800元后，对剩余部分医疗费用的7000元，由统筹基金按90%的比例给予报销，其余的10%由该职工本人支付。这7000元的支付方式属于
A. 封顶线
B. 共同付费
C. 起付比例
D. 自费线
E. 起付线

正确答案：B。共同付费

解析：针对医疗服务需方的共付措施包括起付线、共付比例以及封顶线（CD错）。本题中医药费用除去自费项目1200元，剩下的7800元中，800元属于起付线，即医疗保险开始支付医疗费用的最低标准（E错）：剩下的7000元，由统筹基金按90%的比例给予报销，其余的10%由该职工本人支付，这种支付方式为共同付费，即医疗保险机构按照合同或政府的规定对被保险人的医疗费用按一定的比例进行补偿，剩余比例的费用由个人自己负担（B对）。封顶线为低于封顶线的医疗费用由医疗保险支付，超出封顶线的医疗费用由被保险人自己负担（A错）。